患者，男性，27岁，劳累时心悸，胸骨后疼痛1年。查体可闻及主动脉瓣区收缩期粗糙的喷射性杂音，主动脉瓣区第二心音减弱。X线检查示：左室扩大和升主动脉扩张。可能的诊断是
A. 冠心病心绞痛
B. 非梗阻性肥厚型心肌病
C. 主动脉瓣狭窄
D. 主动脉瓣关闭不全
E. 高血压性心脏病

正确答案：C。主动脉瓣狭窄

解析：患者青年男性，劳累时心悸伴胸骨后疼痛（提示稳定型心绞痛）；查体：可闻及主动脉瓣区收缩期粗糙的喷射性杂音（主动脉瓣狭窄典型杂音），主动脉瓣区第二心音减弱（由主动脉瓣严重狭窄导致左心室射血时间明显延长引起），X线检查示左室扩大和升主动脉扩张（主动脉瓣狭窄典型影像学改变），综合患者的临床表现、体检和影像学检查，可能的诊断是主动脉瓣狭窄（C对）。冠心病心绞痛（A错）虽也有劳累时心悸伴胸骨后疼痛，但心脏杂音多为心尖部收缩期杂音，不会出现主动脉瓣区杂音。非梗阻性肥厚型心肌病（B错）不会出现主动脉瓣区收缩期粗糙的喷射性杂音。主动脉瓣关闭不全（P299）（D错）多有心悸、心前区不适、头颈部强烈动脉搏动感等，其典型杂音为主动脉瓣区（胸骨右缘第二肋间）舒张期高调递减型叹气样杂音。高血压性心脏病（E错）是指高血压长期控制不佳而引起心脏结构和功能的改变。多见于有长期高血压病史的老年患者，主要表现为心力衰竭的症状，而且由于动脉压的升高，会出现主动脉瓣区第二心音亢进，而不是减弱。